在下列文献中，关于人体实验的国际性著名文件是
A. 《夏威夷宣言》
B. 《赫尔辛基宣言》
C. 《希波克拉底誓言》
D. 《东京宣言》
E. 《悉尼宣言》

正确答案：B。《赫尔辛基宣言》

解析：《赫尔辛基宣言》（B对）规定了人体实验的道德准则和限制条件。《夏威夷宣言》（A错）是关于精神病医生的道德准则。《希波克拉底誓言》（C错）是医德行为准则，1948年，世界医师协会对此誓言加以修改，定名为《日内瓦宣言》并作为国际通行的医德规范。《东京宣言》（D错）规定《关于对拘留犯和囚犯给予折磨、虐待、非人道的对待惩罚时医师的行为准则》。《悉尼宣言》（E错）确定了死亡的道德责任和器官移植道德准则。